以下不是决定止血方法选择的是
A. 根据损伤的部位
B. 出血的来源
C. 出血的程度
D. 患者的意愿
E. 现场条件

正确答案：D。患者的意愿

解析：出血的急救，要根据损伤的部位、出血的来源和程度（动脉、静脉或毛细血管）及现场条件采用相应的止血方法。掌握“口腔颌面部创伤急救”知识点。